牛膝、川牛膝均源于苋科，虽均性平归肝肾经，但川牛膝的主治病证不包括
A. 月经不调、痛经、经闭
B. 肝肾亏虚之腰膝酸痛、筋骨无力
C. 小便不利、淋浊涩痛
D. 肝阳上亢、头痛眩晕
E. 吐血、衄血、尿血

正确答案：B。肝肾亏虚之腰膝酸痛、筋骨无力

解析：本题考查的是川牛膝的主治病证。牛膝、川牛膝均源于苋科，虽均性平归肝肾经，但川牛膝的主治病证不包括肝肾亏虚之腰膝酸痛、筋骨无力（B错，为本题正确答案）。川牛膝：【主治病证】（1）月经不调，痛经，闭经（A对），产后瘀阻，关节痹痛，跌打伤痛。（2）小便不利，淋浊涩痛（C对）。（3）吐血，衄血，尿血（E对），牙龈肿痛，口舌生疮。（4）肝阳上亢，头痛眩晕（D对）。肝肾亏虚之腰膝酸痛、筋骨无力为牛膝的主治病证。牛膝：【主治病证】（1）月经不调，痛经，闭经，难产，产后瘀阻腹痛，癥瘕，跌打伤痛。（2）小便不利，淋证涩痛，湿热下注之足膝肿痛。（3）吐血，衄血，牙龈肿痛，口舌生疮。（4）肝阳上亢之头痛眩晕。（5）肝肾亏虚之腰膝酸痛、筋骨无力，风湿痹痛，筋脉拘挛，痿证。